针灸治疗腰痛的主穴是
A. 阿是穴、肾俞、太溪
B. 阿是穴、背俞穴、太溪
C. 委中、昆仑、太溪
D. 命门、昆仑、委中
E. 阿是穴、大肠俞、委中

正确答案：E。阿是穴、大肠俞、委中

解析：治疗腰痛的主穴选肾俞、大肠俞、阿是穴、委中（E对），太溪穴是肾虚腰痛的配伍用穴（ABC错），命门是督脉证的配伍用穴（D错）。